吞咽时哽咽不顺，饮食不下，或食入即吐的病证是
A. 反胃
B. 噎膈
C. 噫气
D. 呃逆
E. 梅核气

正确答案：B。噎膈

解析：患者以哽咽不顺，饮食不下，或食入即吐为主症，故辩证为噎膈（B对）。反胃是指饮食入胃，宿谷不化，经过良久，由胃反出之病（A错）。噫气又称嗳气，为胃气阻郁，气逆于上，冲咽而出，发出沉缓的嗳气声，常伴酸腐气味，食后多发（C错）。呃逆是指胃气上逆动膈，以气逆上冲，喉间呃呃连声，声短而频，难以自制为主要表现的病证（D错）。梅核气者，痰气窒塞于咽喉之间，咯之不出，咽之不下，状如梅核（E错）。